急性支气管炎阴虚咳嗽证的治疗方剂
A. 杏苏散加减
B. 桑菊饮加减
C. 清金化痰汤加减
D. 沙参麦冬汤加减
E. 麻杏甘石汤加减

正确答案：D。沙参麦冬汤加减

解析：急性支气管炎阴虚咳嗽证是由于肺阴受损，虚热内生，热伤肺络或阴虚生燥所致，治疗时应养阴润肺，兼清余热，首选沙参麦冬汤加减（D对）。杏苏散（A错））其功用为清宣凉燥，理肺化痰，适用于急性支气管炎之风寒咳嗽证。桑菊饮（B错）其功用为疏风清热，宣肺止咳，适用于急性支气管炎之风热咳嗽证。清金化痰汤（C错）其功用为清肺化痰止咳，适用于内伤咳嗽之痰热咳嗽。麻杏甘石汤（E错）其功用为辛凉疏表，清肺平喘，适用于外感风邪，邪热壅肺证。